筛检试验的主要目的是
A. 将人群中的健康人与有病或可疑有病的人区别开来
B. 将人群中有病的人与可疑有病的人区别开来
C. 两者均是
D. 两者均否

正确答案：A。将人群中的健康人与有病或可疑有病的人区别开来

解析：本题考查筛检试验的主要目的。筛检试验是用于识别外表健康的人群中那些可能患病个体或具有患病风险个体的方法。其目的是将人群中的健康人与有病或可疑有病的人区别开来（A对BCD错）。